布洛芬口服制剂处方如下：布洛芬20g，羟丙基甲基纤维素20g，山梨醇250g，甘油30ml，枸橼酸适量，蒸馏水加至1000ml。关于布洛芬制剂的说法，正确的是
A. HPMC为增稠剂或助悬剂
B. 该剂型属于口服溶液剂
C. 甘油为助溶剂
D. 山梨醇为甜味剂
E. 枸橼酸为防腐剂

正确答案：A、D。HPMC为增稠剂或助悬剂；山梨醇为甜味剂

解析：本题考查布洛芬处方分析。布洛芬口服混悬剂中，布洛芬为主药，甘油为润湿剂，羟丙基甲基纤维素为助悬剂（A对），山梨醇为甜味剂（D对）。